药材呈倒卵形，略似花瓶状的是
A. 桃仁
B. 女贞子
C. 巴豆
D. 金樱子
E. 瓜蒌

正确答案：D。金樱子